气滞血瘀多与何脏腑的生理功能相关
A. 肺
B. 脾
C. 肾
D. 三焦
E. 以上都不是

正确答案：E。以上都不是

解析：气滞血瘀，指气机郁滞，导致血行障碍；或血行不畅，导致气的运行郁滞，出现气滞和血瘀同时并存的病机变化外伤闪挫，或血瘀及气，而致血瘀气滞；情志抑郁，气机阻滞，而致气滞血瘀。气滞血瘀多与肝失疏泄密切相关（E对ABCD错）。